患者身热，微恶风，汗少，肢体酸重，头昏重胀痛，咳嗽痰粘，鼻流浊涕，心烦，口渴，舌苔薄黄而腻，脉濡数。治疗应首选
A. 银翘散
B. 桑菊饮
C. 新加香薷饮
D. 桑白皮汤
E. 藿香正气散

正确答案：C。新加香薷饮

解析：根据“身热、恶风、流涕、咳嗽、头痛、全身不适”，可知病为“感冒”；根据“头昏重胀痛，咳嗽痰粘，鼻流浊涕，心烦，口渴，舌苔薄黄而腻，脉濡数”可辨为“暑湿伤表证”，治宜清暑祛湿解表，代表方为新加香薷饮（C对）。银翘散为感冒之风热犯表证的代表方（A错）。桑菊饮为咳嗽之风热犯肺的代表方（B错）。桑白皮汤为喘证之痰热郁肺的代表方（D错）。藿香正气散主治外感风寒内伤湿滞证（E错）。